治疗胁痛肝胆湿热证，应首选的方剂是
A. 龙胆泻肝汤
B. 柴胡疏肝散
C. 血府逐瘀汤
D. 一贯煎
E. 茵陈蒿汤

正确答案：A。龙胆泻肝汤

解析：肝胆湿热证之胁痛是由湿热蕴结，肝胆失疏，络脉失和所致，治宜清热利湿，方用龙胆泻肝汤（A对）。柴胡疏肝散为肝气郁滞证之胁痛的代表方（B错）。血府逐瘀汤为瘀血阻络证之胁痛的代表方（C错）。一贯煎为肝络失养证之胁痛的代表方（D错）。茵陈蒿汤为热重于湿证之阳黄的代表方（E错）。